1岁小儿，多汗，枕秃，方颅，常发生惊厥，不伴发热。查血糖3.2mmol/L，血钙6.5mg/dl，血镁1mg/dl，血磷12mg/dl。其确切的诊断应是
A. 低血糖症
B. 婴儿痉挛症
C. 维生素D缺乏性佝偻病
D. 维生素缺乏性手足搐搦症
E. 低镁血症

正确答案：D。维生素缺乏性手足搐搦症

解析：根据题意，该患儿方颅为维生素D缺乏引起，常有不伴发热的惊厥，考虑维生素D缺乏性手足搐搦症（D对），该患儿血糖为3.2mmol/L（正常值≥2.2mmol/L）高于2.2mmol/L，所以排除低血糖症（A错）。该患儿的血镁为1mg/dl，所以排除低血镁症引起的痉挛（E错）。该患儿为方颅，可能为先前缺乏维生素D导致的骨骼改变，结合不发热的惊厥表现，应认定为维生素D缺乏性手足搐搦症伴维生素D缺乏性佝偻病，但主要以维生素D缺乏性手足搐搦症为主，有维生素D缺乏性佝偻病史（C错）。